肝的纵切面
A. 沿人体矢状轴
B. 沿人体冠状轴
C. 沿人体垂直轴
D. 沿肝长轴
E. 沿肝横轴

正确答案：D。沿肝长轴

解析：在描述器官切面时，常以器官自身的长轴为标准，与其长轴平行的切面称纵切面，与其长轴垂直的切面为横切面，故肝的纵切面沿着肝长轴（D对）。